肿瘤由结缔组织构成，钙化结构很多样，骨小梁可相互连接成网；常见无细胞的嗜碱性类牙骨质沉积物，此为以下哪种疾病的病理表现
A. 舌下囊肿
B. 成牙骨质细胞瘤
C. 牙源性纤维瘤
D. 骨化纤维瘤
E. 皮样囊肿

正确答案：D。骨化纤维瘤

解析：骨化纤维瘤界限清楚，有包膜，剖面呈黄白色、呈实性。镜下由富含成纤维细胞的结缔组织构成，其细胞丰富程度可有较大差异。肿瘤中的钙化结构很多样，其周围绕成排的成骨细胞，这些骨小梁可相互连接成网；肿瘤中常可见无细胞的嗜碱性类牙骨质沉积物，呈圆形或卵圆形，周界光滑，类似于牙骨质小体。掌握“骨化纤维瘤”知识点。